巨幼红细胞贫血需要补充
A. 维生素B₁₂
B. 维生素B₁
C. 维生素B₆
D. 维生素A
E. 维生素D

正确答案：A。维生素B₁₂

解析：本题考查维生素B₁₂适应症。巨幼细胞贫血需要补充维生素B₁₂（A对）。